化学毒物生物转化的Ⅰ相反应，不包括下列哪一种反应
A. 甲基化
B. 羟化
C. 共氧化
D. 环氧化

正确答案：A。甲基化

解析：本题考查化学毒物生物转化的Ⅰ相反应。化学毒物生物转化的Ⅰ相反应为氧化、还原和水解反应，包括羟化（B对）、共氧化（C对）、环氧化（D对）反应。甲基化反应（A错，为本题正确答案）属于Ⅱ相反应。